新生儿高胆红素血症，可导致
A. 颅内出血
B. 颅内感染
C. 核黄疸
D. 败血症
E. 支气管肺炎

正确答案：C。核黄疸

解析：新生儿胎粪形成较少及肠蠕动差、胎粪排出常延迟，易形成新生儿高胆红素血症，由于新生儿肝功能不成熟，因此新生儿高胆红素血症以非结合胆红素升高为主，非结合胆红素称脂溶性，可以穿过血脑屏障，导致核黄疸的发生（C对）。颅内出血是可以导致新生儿高胆红素血症，而不是新生儿高胆红素血症导致颅内出血，属于因果倒置性错误（A错）。颅内感染（B错）、败血症（D错）、支气管肺炎（E错）是新生儿高胆红素血症的诱因而不是并发症。